菌体产生外毒素入血而致病，可引起菌血症，甚至脓毒症的是
A. 霍乱弧菌
B. 白喉棒状杆菌
C. 鼠疫杆菌
D. 破伤风梭菌
E. 以上都不是

正确答案：C。鼠疫杆菌